晶状体是位于眼球内的双凸透镜样结构，是眼球的重要调节结构，通过其调节使外界物象光线清晰地落在视网膜上而被感知。关于晶状体的描述，正确的是
A. 不含血管和神经
B. 以睫状小带连于脉络膜的前部
C. 无弹性
D. 周围部较硬
E. 中央部较软

正确答案：A。不含血管和神经

解析：晶状体不含血管和神经（A对），且富有弹性，而非无弹性（C错），并以睫状小带连于睫状体，而非脉络膜的前部（B错）。晶状体的周围部较软（D错），中央部较硬（E错）。